哪项不是颅内高血压性头痛的特点
A. 多为深在性钝痛牵拉，转动性痛
B. 晨起较重
C. 咳嗽、摇头、俯首使头痛加重
D. 常伴呕吐
E. 利尿后头痛加重

正确答案：E。利尿后头痛加重